牙体预备应达到的要求是
A. 去除病变组织，阻止病变发展
B. 消除轴壁倒凹，获得良好就位道
C. 开辟修复体所占空间，保证修复体一定的强度、厚度和美观
D. 预备良好的固位形和抗力形，磨改过长牙、错位牙、异常对颌牙及邻牙，并做适当预防性扩展
E. 以上均是应达到的要求

正确答案：E。以上均是应达到的要求

解析：本题考查牙体预备的要求。牙体预备包括嵌体、全冠、桩核冠、固定桥基牙等的预备，本题以全冠的牙体预备为例说明牙体预备应达到的要求。牙体预备首先应去除病变组织，阻止病变发展（A对）。其次，应消除颊、邻面的倒凹，以获得良好就位道（B对），包括开辟修复体所占空间从而保证修复体一定的强度、厚度和美观（C对）。除此之外，为了达到良好的固位形和抗力形，还应适当磨改过长牙、错位牙、异常对颌牙及邻牙，并做适当预防性扩展（D对）。（ABCD均对，故E为本题的正确答案）。